某医师调查得10名女中学生体重X（kg）与肺活量Y（L），经直线回归分析知，b=0.0748，若如tb＞t0.05，8，按a=0.05可认为
A. 肺活量与体重大小无关
B. 肺活量随体重增加而增加
C. 体重与肺活量间有函数关系存在
D. 体重与肺活量均值差别有统计学意义
E. 体重与肺活量间无线性相关关系存在

正确答案：B。肺活量随体重增加而增加